下面关于病因三角模型的论述，正确的是
A. 它是目前最科学的病因观
B. 它强调宿主因素在发病中的作用
C. 疾病是三大因素相互作用的结果
D. 它强调环境因素在发病中的作用
E. 它强调病原物在发病中的作用

正确答案：C。疾病是三大因素相互作用的结果